下列哪一项不是苯的氨基硝基化合物对血液损害的共同特点
A. 形成高铁血红蛋白
B. 溶血
C. 形成赫恩氏小体
D. 抑制造血干细胞的生长分化

正确答案：D。抑制造血干细胞的生长分化

解析：本题考查苯的氨基硝基化合物对血液系统的损害。苯的氨基硝基化合物对血液系统主要有五方面的损害：①高铁血红蛋白（A对）形成；②硫血红蛋白形成；③溶血（B对）作用；④形成变性珠蛋白小体：又名赫恩滋小体（C对）；⑤引起贫血。目前，尚无法证明苯的氨基硝基化合物会抑制造血干细胞的生长分化（D错，为本题正确答案）。